左心房有
A. 主动脉口
B. 卵圆窝
C. 两个肺静脉口
D. 冠状窦口
E. 四个肺静脉口

正确答案：E。四个肺静脉口

解析：左心房窦腔面光滑，后壁两侧各有一对肺静脉开口，即四个肺静脉口（E对）。